落实初级卫生保健，以下不是政府的伦理责任的是
A. 加强健康教育
B. 创建公众健康良好的生存
C. 公正、合理地分配卫生资源
D. 实施初级卫生保健的各项政策和具体揩施
E. 促进人人维护健康

正确答案：D。实施初级卫生保健的各项政策和具体揩施